属于顺式元件的是
A. 辅阻遏蛋白
B. TFⅡB
C. CAP
D. 乳糖
E. 抑制基因

正确答案：A。辅阻遏蛋白